一年轻人在打羽毛球时自己的球拍把额头碰破了一块皮，到某医院就医。接诊医生查看后。问明患者属公费医疗，于是开出了CT检查单。查后结果为阴性。此类现象产生的根源是
A. 医生诊断水平不高
B. 医生对高新技术手段过度迷信
C. 市场经济对医学服务的负面影响
D. 生物医学模式对医生的负面影响
E. 医院管理不到位

正确答案：C。市场经济对医学服务的负面影响